疝内容物经回纳后，压住腹股沟管内环，不出现的是
A. 股疝
B. 腹股沟直疝
C. 腹股沟斜疝
D. 脐疝
E. 切口疝

正确答案：C。腹股沟斜疝

解析：腹股沟疝是指发生于腹股沟区的腹外疝。腹股沟疝可分为斜疝和直疝。斜疝指疝囊从腹壁下动脉外侧的腹股沟管内环突出，逐渐向下、内、前方穿越腹股沟管，出外环到达体表，可进入阴囊。疝内容物经回纳后，压住腹股沟管内环，疝块不再突出（C对）。疝囊经股环、股管向卵圆窝突出的疝称股疝（A错）。直疝（B错）回纳疝块后压住内环，疝块仍可突出。脐部形成的腹外疝称脐疝（D错）。腹壁手术切口处形成的疝称切口疝（E错）。